内痔的常见早期症状是
A. 肛门疼痛
B. 大便时滴血
C. 痔核脱出
D. 粘液血便
E. 肛门周围红肿

正确答案：B。大便时滴血

解析：内痔是肛垫的支持结构、静脉丛及动静脉吻合支发生病理性改变或移位。内痔分四度，早期属第Ⅰ度，在第Ⅰ度中只会表现大便时滴血（B对）。内痔主要表现为出血和脱出，一般无肛门疼痛（A错）。痔核脱出（C错）在内痔中晚期（II度、III度、IV度）出现。内痔一般无粘液血便（D错）。肛门周围红肿（E错）为肛门周围炎症的表现，一般见于肛周脓肿和肛瘘。